肾小管对HCO₃⁻重吸收的叙述错误的是
A. 主要在近球小管重吸收
B. 与H⁺的分泌有关
C. 以CO₂的形式重吸收
D. 需碳酸酶的参与
E. 滞后于Cl⁻的重吸收

正确答案：E。滞后于Cl⁻的重吸收

解析：肾小管对HCO₃⁻的重吸收约80%在近端小管（A对）。肾小管对HCO₃⁻的重吸收与H⁺（B对）相结合为H₂CO₃，然后分解为CO₂和水。CO₂很快以单纯扩散的方式进入上皮细胞被重吸收（C对），CO₂和水又在碳酸酐酶（D对）的催化下形成H₂CO₃，后者又很快解离成H⁺和HCO₃⁻。在近端小管前半段，HCO₃⁻便被重吸收，Cl⁻却不被重吸收。重吸收入细胞内的大部分HCO₃⁻与其他离子以同向转运的方式进入细胞间液，小部分则通Cl⁻-HCO₃⁻交换的方式进入细胞间液，此时Cl⁻才被重吸收，故HCO₃⁻的重吸收优先于Cl⁻的重吸收（E错，为本题正确答案）。